男，54岁。活动时喘憋渐加重，出现夜间憋醒。高血压病史10余年。超声心动图：左心房、左心室扩大，LVEF35%。患者喘憋的机理为
A. 左心室充盈压明显降低
B. 左心室舒张功能明显受损
C. 左心室每搏功明显高于右心室每搏功
D. 左心室心搏出量明显少于右心室心搏出量
E. 心室搏出量占心室舒张末容积的百分比明显降低

正确答案：E。心室搏出量占心室舒张末容积的百分比明显降低

解析：患者高血压病史10余年，活动时喘憋渐加重，出现夜间憋醒（夜间阵发性呼吸困难的典型表现），超声心动图检查示：左心房、左心室扩大，LVEF35%（健康成年人的射血分数为55%～65%，＜50%提示左心功能不全），患者可诊断为左心衰竭。左心衰患者夜间平卧后，回心血量增多，但心室搏出量占心室舒张末容积的百分比（即射血分数）（九版生理学P89）明显降低（E对），血液瘀滞于肺部，出现憋喘症状。左心衰患者以收缩功能降低为主，舒张功能（降低见于肥厚型心肌病等）并没有明显受损（B错），当心肌代偿性肥厚增大时，可出现左心室充盈压增高（A错）。一般左心室每搏功会明显高于右心室每搏功（C错），但其并非患者发生喘憋的机理。左心室心搏出量应等于右心室心搏出量（D错）。